主要作用于聚合态的微管，抑制微管解聚的药物是
A. 紫杉醇
B. 顺铂
C. 氟尿嘧啶
D. 三尖杉酯碱
E. 放线菌素D

正确答案：A。紫杉醇

解析：本题考查紫杉醇。主要作用于聚合态的微管，抑制微管解聚的药物是紫杉醇（A对）。紫杉醇能促进微管聚合，同时抑制微管的解聚，从而使纺锤体失去正常功能，细胞有丝分裂停止。顺铂（B错）可与DNA结合，破坏其结构与功能，使肿瘤细胞DNA复制停止，阻碍细胞分裂，为细胞增殖周期非特异性抑制剂。氟尿嘧啶（C错）在细胞内经酶转变为5-氟尿嘧啶脱氧核苷酸（5F-dUMP）而竞争性抑制脱氧胸苷酸合成酶，阻止脱氧尿苷酸（dUMP）甲基化为脱氧胸苷酸（dTMP），从而影响DNA的合成。三尖杉酯碱（D错）可抑制蛋白质合成的起始阶段，并使核糖体分解，释出新生肽链，但对mRNA或tRNA与核糖体的结合无抑制作用，属细胞周期非特异性药物，对S期细胞作用明显。放线菌素D（E错）能与DNA双螺旋结合产生细胞毒性，嵌入DNA的鸟苷和胞苷的碱基对之间，阻断RNA多聚酶对DNA的转录。